锥体系中的皮质核束支配的单侧脑神经运动核是
A. 动眼神经核
B. 滑车神经核
C. 疑核
D. 舌下神经核
E. 无

正确答案：D。舌下神经核

解析：锥体系中的皮质核束支配的单侧脑神经运动核是面神经核下部和舌下神经核（D对）。动眼神经核（A错）、滑车神经核（B错）、舌下神经核（D错）受双侧脑神经运动核支配。